对四环素不敏感的病原体是
A. 革兰阳性球菌
B. 结核杆菌
C. 革兰阴性菌
D. 肺炎支原体
E. 立克次体

正确答案：B。结核杆菌

解析：四环素的抗菌谱较广，对多数革兰阳性菌（A对）和革兰氏阴性菌（C对）均有抑制作用。对立克次体（E对）作用较强，对衣原体、支原体、螺旋体、放线菌也有抑制作用，临床可用于立克次体感染如斑疹伤寒、羌虫病和Q热等，还可用于支原体属感染，如肺炎支原体（D对），泌尿生殖系统感染等，对伤寒杆菌、副伤寒杆菌、铜绿假单胞菌、结核分枝杆菌（B错，为本题正确答案）、真菌、病毒无效。